解救蟾酥中毒，可以注射的药物是
A. 阿托品
B. 解磷定
C. 二巯丙醇
D. 亚硝酸钠
E. 苯巴比妥钠

正确答案：A。阿托品

解析：本题考查的是蟾酥及含蟾酥的中成药的中毒解救。解救蟾酥中毒，可以注射的药物是阿托品（A对）。蟾酥及含蟾酥的中成药的中毒解救：1.清除毒物，如洗胃、灌肠、导泻、较大量静脉输液。服用蛋清、牛奶保护胃黏膜并大最饮水或浓茶。2.对症治疗，如注射阿托品，服用颠茄合剂等。3.甘草、绿豆煎汤饮用，或以生姜捣汁、鲜芦根捣汁内服。二巯丙醇（C错）可解雄黄及含雄黄的中成药的中毒。雄黄及含雄黄的中成药的中毒解救：1.清除毒物，如催吐、洗胃、导泻、输液，服用牛奶、蛋清、豆浆、药用炭等吸附毒物，保护黏膜，必要时可应用二巯基丙醇类。2.纠正水液代谢和电解质紊乱，抗休克、肾透析等对症治疗。3.甘草、绿豆煎汤饮用，也可用中医对症治疗。亚硝酸钠（D错）可用于苦杏仁不良反应的救治。苦杏仁的不良反应救治：（1）如在食后4小时内出现中毒症状，则用1：5000～1：2000的高锰酸钾液及大量清水或3%过氧化氢充分洗胃催吐，然后服硫代硫酸钠2g，也可用10%硫代硫酸钠溶液洗胃，并留置100ml在胃中，使与胃肠道的氢氰酸结合成无毒的硫氰酸化合物，亦可15分钟口服1匙硫酸亚铁液。（2）联合使用亚硝酸钠和硫代硫酸钠：亚硝酸盐能与血红蛋白形成高铁血红蛋白，而氰离子（CN⁻）则能与高铁血红蛋白结合成氰化高铁血红蛋白，从而解除了氰离子对细胞呼吸酶的抑制，但氰化高铁血红蛋白在数分钟后又逐渐解离放出氰离子，故需立即注射硫代硫酸钠，使其与氰离子形成稳定的硫氰酸盐，由尿排出体外。（3）如无亚硝酸钠，可用亚甲蓝按10mg/kg剂量加入5%葡萄糖注射液40ml中静脉注射，再接着注射硫代硫酸钠，但疗效不如亚硝酸钠。（4）可用依地酸二钴按5～15mg/kg，加入50%的葡萄糖注射液内静脉注射，必要时可重复应用8～10次，本品与氰基结合力大于细胞色素氧化酶与氰基结合力，0.8g依地酸二钴可结合0.1g氰离子。（5）葡萄糖的醛基能与氰离子结合成无毒的腈类，静脉注射高渗葡萄糖液，并可促进毒物排泄，防治脑水肿和肺水肿。（6）对症治疗：必要时给呼吸兴奋剂、强心剂、镇静剂及升压药物等，重症患者给细胞色素C，根据循环、呼吸情况给予其他处理，如吸氧、人工呼吸等。（7）中药治疗：①杏树根60～90g，煎汤内服，每4小时1次。②生萝卜或白菜1～1.5kg，捣烂取汁，加红糖或白糖适量，调匀频服。③蕹菜根0.5kg捣烂，开水冲服。④桂枝、乌药、赤芍各9g，红花、桃仁各15g，朱砂1.5g（冲服），水煎，早晚分服。⑤甘草、黑大枣各120g，水煎服。⑥绿豆60g，水煎，加砂糖内服。苯巴比妥钠（E错）可解马钱子及含马钱子的中成药的中毒。马钱子及含马钱子的中成药的中毒解救：1.患者需保持安静，避免声音、光线刺激（因外界刺激可引发惊厥痉挛），吸氧。2.清除毒物，洗胃、导泻。较大量的静脉输液，以加快排泄。3.对症治疗，痉挛时可静脉注射苯巴比妥钠0.2～0.3g。4.肉桂煎汤或甘草煎汤饮服。解磷定（B错）的功效，2022年考试指南未明确说明。